HBV感染进入后期与传染减低的指标是
A. HBsAg（+）
B. 抗-HBs（+）
C. HBeAg（+）
D. 抗-HBc（+）
E. 抗-HBe（+）

正确答案：E。抗-HBe（+）

解析：感染进入后期与传染减低的指标是抗-HBe（+）（E对）抗-HBe（+）提示病毒复制多处于静止状态，传染性降低。HBsAg（+）（A错）见于无症状的乙型肝炎携带者和慢性乙型肝炎患者。抗-HBs（+）（B错）见于乙型肝炎恢复期、既往感染及乙肝疫苗接种后。HBeAg（+）（C错）表明患者处于高感染低应答期。抗-HBc（+）（D错）提示乙型肝炎急性期或慢性肝炎急性发作。